一男孩出生后8个月发病。反复感染，淋巴组织中查不到mIg阳性细胞，无生发中心，扁桃体小，血清中IgG、IgA、IgD含量极低，T细胞功能正常。该疾病是
A. Bruton症（X性连锁无丙种球蛋白血症）
B. X性连锁高IgM综合征
C. Ig 重链缺乏.
D. 婴儿暂时性低丙种球蛋白血症
E. 选择性IgA缺陷

正确答案：A。Bruton症（X性连锁无丙种球蛋白血症）